关于log-rank检验，以下说法不正确的是
A. Log-rank检验可用于两条生存曲线的比较，但不适用于多条生存曲线的比较
B. Log-rank检验的基本思想是实际死亡数与期望死亡数之间的比较
C. Log-rank检验对生存率进行比较时，要求两组生存曲线不能交叉
D. Log-rank检验的检验统计量为x²统计量
E. Log-rank检验是一种单因素的统计分析方法，并没有考虑其他因素的影响

正确答案：A。Log-rank检验可用于两条生存曲线的比较，但不适用于多条生存曲线的比较

解析：本题考查log-rank的特征。对数秩检验（log-rank test）是比较多组生存曲线（A错，为本题正确答案）的一种常用的非参数检验方法；log-rank检验的基本思想是实际死亡数与期望死亡数之间的比较（B对）；log-rank检验对生存率进行比较时，要求两组生存曲线不能交叉（C对）；log-rank检验的检验统计量为x²统计量（D对）；log-rank检验是一种单因素的统计分析方法，并没有考虑其他因素的影响（E对）。